下列什么与时间分布无关
A. 短期波动
B. 季节性
C. 周期性
D. 长期变异
E. 年龄分布

正确答案：E。年龄分布

解析：本题考查时间分布的描述。疾病的时间分布特征与变化规律可以从短期波动（A对）、季节性（B对）、周期性（C对）、长期趋势（D对）等几个方面进行归纳与描述。年龄分布（E错，为本题正确答案）属于人群分布的一种。